男，44岁。大量饮酒后出现上腹部剧烈疼痛，伴呕吐，呕吐后腹痛不缓解。保守治疗2天，病情持续恶化，并出现休克。查体：T38.9℃，脐周及背部可见大片青紫瘀斑，上腹腹肌紧张，压痛反跳痛明显，肠鸣音减弱。首先考虑的诊断是
A. 十二指肠乳头肿瘤
B. 消化性溃疡并穿孔
C. 急性肝脓肿
D. 重症急性胰腺炎
E. 急性梗阻化脓性胆囊炎

正确答案：D。重症急性胰腺炎

解析：青年男性患者，大量饮酒后（急性胰腺炎的常见病因）出现上腹部剧烈疼痛，伴呕吐，呕吐后腹痛不缓解（急性胰腺炎的典型临床表现）。保守治疗2天，病情持续恶化，并出现休克（提示病情危重）。查体：T38.9℃，脐周及背部可见大片青紫瘀斑（Cullen征及Grey-Turner征，提示为重症急性胰腺炎），上腹腹肌紧张，压痛反跳痛明显（典型的腹膜刺激征表现），肠鸣音减弱（提示存在肠麻痹）。综合该患者的病史及体查，首先考虑的诊断是重症急性胰腺炎（D对）。十二指肠乳头肿瘤（A错）发病缓慢，可表现为黄疸、十二指肠梗阻。消化性溃疡并穿孔（P340）（B错）多表现为上腹部刀割样剧痛，迅速波及全腹，腹膜刺激征强烈，呈“板状腹”，不出现Cullen征及Grey-Turner征。急性肝脓肿（P414）（C错）主要表现为寒战、高热、肝区疼痛和肝肿大，可有恶心、呕吐、食欲减退等消化道症状。急性梗阻化脓性胆管炎（P445）（E错）典型表现为Reynolds五联征，即腹痛、寒战高热、黄疸、休克及神经精神症状。